子痰初期内治宜用
A. 萆薢化毒汤
B. 透脓散
C. 阳和汤
D. 五味消毒饮
E. 苦参汤

正确答案：C。阳和汤

解析：萆薢化毒汤适用于湿热疮疡，气血实者（A错）。透脓散适用于成脓期，为透托法代表方剂（B错）。子痰初期多为痰浊凝结证，治疗以阳和汤加减，配服小金丹（C对）。五味消毒饮适用于热毒炽盛证（D错）。苦参汤适用于湿热下注证（E错）。